下列属于心理生理应激性疾病的是
A. 消化性溃疡
B. 神情错乱
C. 营养不良
D. 创伤性感染
E. 败血症

正确答案：A。消化性溃疡